病毒性肝炎肝阴不足证，常用的中药是
A. 山萸肉、龟板
B. 柴胡、郁金
C. 龙胆草、栀子
D. 白术、扁豆
E. 黄芪、党参

正确答案：A。山萸肉、龟板

解析：病毒性肝炎肝阴不足证，常见头晕耳鸣，两目干涩，咽干，失眠多梦，五心烦热，腰膝酸软，女子经少或经闭，舌红体痩、少津或有裂纹，脉细数等症，治疗当以山萸肉、龟板（A对）之品以养血柔肝、滋阴补肾。柴胡、郁金（B错）具有疏肝理气解郁之功，常用于肝气郁结之证。龙胆草、栀子（C错）具有清热利湿解毒之功，常用于肝胆湿热之证。白术、扁豆（D错）具有健脾益气渗湿之功，常用于脾虚湿盛之证。黄芪、党参（E错）具有补脾益气之功，常用于脾气虚弱之证。